三氯甲烷和卤代羟基呋喃酮已被IARC列为对人类的
A. 致癌物（1类）
B. 很可能致癌物（2A类）
C. 可能致癌物（2B类）
D. 无法分类的致癌物（3类）
E. 很可能不致癌物（4类）

正确答案：C。可能致癌物（2B类）

解析：本题考查被IARC列为可能致癌物（ⅡB类）的物质。在生活饮用水标准中，三氯甲烷、卤代羟基呋喃酮、一溴二氯甲烷、二氯乙酸、溴酸盐（钾）等已被IARC列为可能致癌物(ⅡB类）（C对ABDE错）。